男，20岁。1型糖尿病病史10年，平时每日4次胰岛素强化治疗。近2日发热，咽痛，食欲不住，进食少，自行停用胰岛素。晨起家属发现患者不能正确回答问题，急诊就诊，查体：T38.5°C，精神差，轻度脱水貌。实验室检查：血钠140mmol/L，血钾4.5mmol/L，血糖25mmol/L，血pH7.25，尿酮体（＋＋＋）。【假设信息】该患者经胰岛素及补液治疗后，尿量增加至40~50mI/h。为纠正电解质及酸碱平衡紊乱，此时应采取的治疗措拖是
A. 补碱、补钾、补钠治疗
B. 补碱、补钾治疗
C. 补钠、补钙治疗
D. 补碱、补钠治疗
E. 补钾、补钠治疗

正确答案：E。补钾、补钠治疗

解析：1型糖尿病患者（有自发DKA倾向），平时每日4次胰岛素强化治疗。近2日发热，咽痛，食欲不住，进食少，自行停用胰岛素。晨起家属发现患者不能正确回答问题，精神差，轻度脱水貌。血糖16.7-33.3mmol/L、酸中毒、尿酮体（＋＋＋）（DKA典型表现）。该患者最可能的诊断为DKA。该患者经胰岛素及补液治疗后，尿量增加至40~50mI/h。为纠正电解质及酸碱平衡紊乱，此时应采取的治疗措拖是补钾、补钠治疗（E对）。DKA病人有不同程度失钾，治疗前的血钾水平不能真实反映体内缺钾程度，补钾应根据血钾和尿量：血钾正常、尿量>40ml/h，也立即开始补钾（C错）。补液后同时应补钠。DKA经输液和胰岛素治疗后，酮体水平下降，酸中毒可自行纠正，一般不必补碱，补碱指征为血pH<7.1（ABD错）。